以下哪项不属于窝沟易患龋的因素
A. 点隙窝沟的解剖形态
B. 窝沟的深度
C. 窝沟口被填塞
D. 点隙窝沟接近釉质牙本质界
E. 窝沟中容易存留唾液

正确答案：E。窝沟中容易存留唾液

解析：窝沟易患龋与很多因素有关：①点隙窝沟的解剖形态易为细菌聚集定植；②窝沟的深度不能直接为个体与专业人员清洁所达到；③窝沟口被有机填塞物、再生釉质上皮、食物残渣，甚至菌斑形成阻挡，阻止局部用氟的进入；④点隙窝沟接近釉质牙本质界，故龋的发生，较之平滑面早而深。掌握“窝沟封闭术”知识点。